出血性梗死常发生于
A. 肾、肠
B. 脾、肺
C. 肺、肠
D. 心、肠
E. 肾、心

正确答案：C。肺、肠

解析：根据梗死灶内的含血量多少，可将梗死分为贫血性梗死、出血性梗死和败血性梗死。其中出血性梗死常发生于组织疏松，有双重血液循环的器官伴有严重淤血时，如肺、肠（C对）和卵巢等；贫血性梗死（P58）主要发生于组织结构较致密、侧枝循环不充分的实质器官，如心、肾、脾等；败血性梗死常见于急性感染性心内膜炎。